影响合理用药的因素中，人的因素尚不包括的人员是
A. 医师
B. 药师
C. 病人
D. 护士
E. 律师

正确答案：E。律师

解析：本题考查影响合理用药的因素。影响合理用药的人员因素不包括律师（E错，为本题正确答案）。影响合理用药常见的原因包括人员培训缺失，医生（A对）、护士（D对）和药师（B对）因为不了解药品的正确使用方法，可能导致用药错误。患者（C对）也会导致用药错误。